用10%氯化钠注射液9ml，加适量注射用水稀释成90ml的溶液，其氯化钠浓度是
A. 0.1
B. 0.001
C. 0.01
D. 0.009
E. 0.05

正确答案：C。0.01

解析：本题考查体积比体积百分浓度计算公式。浓度=溶质/溶液=9×10%/90=0.01（C对）。